下列各项不属妇科临床常见情志致病因素
A. 郁怒
B. 忧愁
C. 狂喜
D. 思虑
E. 惊恐

正确答案：C。狂喜

解析：妇科常见情志致病因素为怒、思、恐（C对）。怒（A错）使气郁、气逆，进而引起血分病变，可致月经后期、闭经、痛经、经行吐衄、不孕、瘾瘕等；忧思（BD错）气结、伤脾，可致月经失调、闭经、胎动不安等；惊恐（E错）伤肾，每使气下、气乱，可致月经过多、崩漏、胎动不安、堕胎、小产等，甚或闭经。